下列哪条动脉的分支不直接分布到胃
A. 胃右动脉
B. 胃后动脉
C. 胃十二指肠动脉
D. 胃短动脉
E. 胃网膜左、右动脉

正确答案：C。胃十二指肠动脉

解析：胃右动脉（A对）、胃后动脉（B对）、胃短动脉（D对）、胃网膜左、右动脉（E对）的分支均直接分布到胃。胃十二指肠动脉（C错，为本题正确答案）发出胃网膜右动脉分布到胃，故不是直接分布到胃。